男，21岁。发热、咳嗽3天入院。胸部X线片显示右下肺叶实变，或呈小叶状浸润，其中有单个或多发的液气囊腔。查血WBC13×10⁹/L。该患者最可能感染的病原菌是什么
A. 肺炎克雷伯杆菌
B. 肺炎支原体
C. 结核分枝杆菌
D. 肺炎链球菌
E. 金黄色葡萄球菌

正确答案：E。金黄色葡萄球菌

解析：患者为青年男性，发热、咳嗽，胸部X线片显示右下肺叶实变，或呈小叶状浸润，其中有单个或多发的液气囊腔（为金黄色葡萄球菌肺炎胸片典型的改变），血WBC13×10⁹/L（正常值为4～10×10⁹/L），根据其临床表现和辅助检查，考虑诊断为金黄色葡萄球菌（E对）肺炎。克雷伯杆菌肺炎（A错）临床表现起病急，寒战、高热，咳砖红色胶冻样痰，晚期肺叶或肺段实变。支原体肺炎（P49）（B错）以儿童和青年人居多，起病较缓慢，症状主要为乏力、咽痛、咳嗽、发热、肌痛、胸片显示肺部多种形态的浸润影，呈阶段性分布。肺结核（P65）（C错）临床表现咳嗽、咳痰或痰中带血，常有长期午后潮热、乏力、盗汗及消瘦。肺炎链球菌肺炎（P46）（D错）起病急、寒战、高热、咳铁锈色痰、胸痛，X线显示肺实变体肺叶或肺段实变，无空洞，可伴胸腔积液征。